足阳明胃经的郄穴是
A. 地机
B. 养老
C. 外丘
D. 郄门
E. 梁丘

正确答案：E。梁丘

解析：本题考查各经脉的郄穴。地机穴为足太阴脾经的郄穴（A错）。养老为手太阳小肠经的郄穴（B错）。外丘为足少阳胆经的郄穴（C错）。郄门为手厥阴心包经的郄穴（D错）。梁丘为足阳明胃经的郄穴（E对）。